某女，43岁。月经提前，量多，经色深红，质稠，有血块，少腹胀痛，口苦咽干；舌红苔薄黄，脉弦数。诊断为月经先期，辨析其证候是
A. 肝郁血热
B. 瘀血阻络
C. 气阴两虚
D. 肾阳不足
E. 气血两虚

正确答案：A。肝郁血热

解析：本题考查的是月经先期的辨证论治。某女，43岁。月经提前，量多，经色深红，质稠，有血块，少腹胀痛，口苦咽干；舌红苔薄黄，脉弦数。诊断为月经先期，辨析其证候是肝郁血热（A对）。月经先期：月经周期提前7天以上，甚至10余日一行，连续两个周期以上者，称为“月经先期”，既往亦称“经期超前”“经行先期”“经早”“经水不及期”等。（一）脾气虚证：【症状】月经周期提前，经量多，色淡红，质清稀；神疲乏力，气短懒言，小腹空坠，纳少便溏。舌淡红，苔薄白，脉细弱。（二）肾气虚证：【症状】月经周期提前，经量或多或少，色淡暗，质清稀；腰膝酸软，头晕耳鸣，面色晦暗或面有暗斑。舌淡暗，苔白，脉沉细。（三）肝郁血热证：【症状】月经周期提前，经量或多或少，经色深红或紫红，质稠，经行不畅，或有块；或少腹胀痛，或胸闷胁胀，或乳房胀痛，或心烦易怒，口苦咽干。舌红，苔薄黄，脉弦数。崩漏瘀血阻络证（B错）：【症状】经血非时而下，量时多时少，时出时止，或淋沥不断，或停闭数月又突然崩中，继之漏下，经色暗有血块；舌质紫暗或尖边有瘀点，脉弦细或涩。胸痹气阴两虚证（C错）：【症状】胸闷隐痛，时作时止，心悸气短，动则益甚，伴倦怠懒言，易汗出，头晕，失眠多梦。舌红或淡红，舌体胖且边有齿痕，苔薄白或少，脉细缓或结代。阳痿肾阳不足证（D错）：【症状】阳事不举，或举而不坚，精薄清冷；伴神疲倦怠，形寒肢冷，阴部冷凉，面色无华，头晕耳鸣，腰膝酸软，小便清长。舌淡胖，苔薄白，脉沉细。崩漏气血两虚证（E错）：【症状】出血量多或淋沥不尽，血色淡薄，面色无华，气短懒言，食欲不振，便溏。舌质淡，苔薄白湿润，脉细弱。